男性，70岁。间断上腹痛20余年，2月来加重伴饱胀，体重下降6kg，Hb：90g/L，最可能的诊断是
A. 慢性胆囊炎
B. 慢性肝炎
C. 胃癌
D. 消化性溃疡
E. 功能性消化不良

正确答案：C。胃癌

解析：老年男性患者，有20余年上腹痛病史（考虑慢性胃炎或消化性溃疡），2月来腹痛加重伴饱胀（上腹痛规律改变），体重下降、Hb90g/L（中度贫血，正常值为120～160g/L），提示有恶病质表现。综合患者病史与实验室检查，考虑诊断为胃癌（C对）。慢性胆囊炎（A错）多见于40岁左右肥胖女性，主要表现为与进食油腻食物相关的腹痛，不会有体重明显下降及贫血。慢性肝炎（B错）多见于30～50岁男性，常见症状是乏力、食欲下降、肝区隐痛，无体重减轻。消化性溃疡（P359）（D错）常表现为与进食有关的节律性腹痛。功能性消化不良（P384）（E错）无器质性病变，主要表现为餐后饱胀、早饱感等。